铸造卡环的描述，不恰当的是
A. 卡环臂起始部分宽厚，越向尖端越窄薄
B. 卡环臂尖有固位、支持、稳定作用
C. 卡环臂常用的为圆形、半圆形和扁平形三种
D. 卡环体位于基牙非倒凹区
E. 卡环臂尖位于基牙倒凹区

正确答案：B。卡环臂尖有固位、支持、稳定作用

解析：本题考查铸造卡环。铸造卡环的描述，不恰当的是卡环臂尖有固位、支持、稳定作用（B错，为本题的正确答案）。卡环臂尖为卡环的游离部，富有弹性，卡环臂尖位于倒凹区，是卡环产生同位作用的主要部分，无支持作用。以典型的铸造三臂卡环为例，由卡环臂、卡环体、支托和连接体组成。卡环臂为卡环游离部分，富有弹性。卡环臂起始部分宽厚，越向尖端窄薄（A对），起稳定作用，防止义齿移位。卡环臂尖位于倒凹区（E对），是卡环产生固位作用的主要部分，不具有支持和稳定的作用。卡环臂的形态依所用材料和制作方法不同，常用的为圆形、半圆形和扁平形三种（C对）。卡环体环抱于基牙的非倒凹区（D对），可防止义齿龈向和侧向移动，起稳定和支持义齿的作用。